以下哪类药物属于Ⅱ类——β肾上腺素受体阻断药
A. 普鲁卡因胺
B. 苯妥英
C. 普罗帕酮
D. 普萘洛尔
E. 氟卡尼

正确答案：D。普萘洛尔

解析：Ⅱ类——β肾上腺素受体阻断药。本类药有普萘洛尔等。掌握“抗心律失常药”知识点。